葡萄糖-6-磷酸脱氢酶（G⁻6-PD）缺陷患者，服用对乙酰氨基酚易发生
A. 溶血性贫血
B. 系统性红斑狼疮
C. 血管炎
D. 急性肾小管坏死
E. 周围神经炎

正确答案：A。溶血性贫血

解析：本题考查影响药物的作用因素。溶血性贫血（A对）是葡萄糖-6磷酸脱氢酶（G⁻6-PD）缺陷患者，服用对乙酰氨基酚易发生的不良反应。葡萄糖-6-磷酸脱氢酶（G⁻6-PD）缺陷：G⁻6-PD有许多不同亚型，其缺陷有广泛的种族分布，但以黑人和地中海地区的人群较为常见。我国缺乏G⁻6-PD人群的分布很广。当有此种缺陷者应用氧化性药物后，极易引起药源性氧化性溶血性贫血。许多药物代谢酶的遗传多态性反映在种族之间，乙酰基转移酶为磺胺类药物、异烟肼、对氨基水杨酸、普鲁卡因胺等药物的体内代谢酶。在人群中乙酰基转移酶分为两种类型，快乙酰基化型和慢乙酰基化型，中国人和日本人多为快乙酰基化型，白种人多为慢乙酰基化型，服用抗结核病药物异烟肼，在白种人易致多发性神经炎，而在黄种人易致肝损害。异烟肼慢代谢者由于肝脏中N-乙酰基转移酶不足甚至缺乏，服用相同剂量异烟肼，其血药浓度比快代谢者高，药物蓄积而导致体内维生素B₆缺乏引起周围神经炎（E错）。系统性红斑狼疮（B错）是在遗传因素、环境因素、雌激素水平等各种因素相互作用下，导致T淋巴细胞减少、T抑制细胞功能降低、B细胞过度增生，产生大量的自身抗体，并与体内相应的自身抗原结合形成相应的免疫复合物，沉积在皮肤、关节、小血管、肾小球等部位。在补体的参与下，引起急慢性炎症及组织坏死（如狼疮肾炎），或抗体直接与组织细胞抗原作用，引起细胞破坏（如红细胞、淋巴细胞及血小板壁的特异性抗原与相应的自身抗体结合，分别引起溶血性贫血、淋巴细胞减少症和血小板减少症），从而导致机体的多系统损害。血管炎（C错）是血管壁及血管周围有炎细胞浸润，并伴有血管损伤，包括纤维素沉积、胶原纤维变性、内皮细胞及肌细胞坏死，又称脉管炎。致病因素直接作用于血管壁的为原发性血管炎，在血管炎症基础上产生一定的临床症状和体征者为血管炎疾病；由邻近组织炎症病变波及血管壁致病的为继发性血管炎。急性肾小管坏死（D错）为急性肾衰最常见的一种类型，是各种病因所引起的肾组织缺血及/或中毒性损害导致肾小管上皮细胞损伤/坏死，因而肾小球滤过率（GFR）急剧降低而出现的临床综合征，一般表现为进行性氮质血症、水电解质与酸碱平衡失调和相关的一系列症状，中重度急性肾小管坏死的患者不仅肾衰竭严重，而且常常合并一种或多种并发症，有时可危及生命，需要及时积极治疗和抢救。急性肾小管坏死的病因主要有急性肾缺血、急性肾毒性损害、血管内溶血、某些感染引等。有时肾缺血、肾毒性损害等因素可同时存在。